《中华人民共和国传染病学防治法》规定，国家建立传染病学疫情
A. 预防接种制度
B. 全民预防措施
C. 信息公布制度
D. 菌种运输管理制度
E. 鉴定制度

正确答案：C。信息公布制度

解析：《传染病防治法》规定，国家建立传染病疫情信息公布制度（C对）。公布传染病疫情信息应当及时、准确。国务院卫生行政部门定期公布全国传染病疫情信息。省、自治区、直辖市人民政府卫生行政部门定期公布本行政区域的传染病疫情信息。